治疗药物评价的内容，一般不包括的项目是
A. 有效性
B. 安全性
C. 经济性
D. 依从性
E. 药品质量

正确答案：D。依从性

解析：本题考查治疗药物评价。依从性（D错，为本题正确答案）不是治疗药物评价内容。治疗药物评价包括：（1）有效性评价（A对）；（2）安全性评价（B对）；（3）药物经济学评价（D对）；（4）质量评价（E对）。